下面描述输尿管的说法，正确的是
A. 为细长的肌性管道
B. 腹段行于腰大肌前方
C. 分为腹、盆、壁内段三部分
D. 在女性经子宫动脉后下方达膀胱
E. 以上全对

正确答案：E。以上全对

解析：输尿管为细长的肌性管道（A对），可分为腹、盆、壁内段三部分（C对）。腹部起自肾盂下端，经腰大肌前面下行（B对），女性输尿管盆部经子宫动脉后下方达膀胱（D对，故E为本题正确答案）。